男，60岁。发热伴寒战、心悸7天，体温最高39度，头痛咳嗽，右大腿肿痛，病情渐重入院。查体：T38度，P100次/分，R24次/分，BP100/75mmHg。神志清楚，巩膜轻度黄染，双肺呼吸音粗，无啰音，心脏无异常，腹平软、无压痛，肝区无叩痛。右大腿中段红肿，范围约10cm，压痛明显，有波动感。血WBC20×10⁹/L，Hb100g/L，多次血培养（-）。对该患者，最恰当的处理是
A. 应用针对G⁻菌抗生素
B. 适当输注新鲜血
C. 应用糖皮质激素
D. 抗休克治疗
E. 切开引流

正确答案：E。切开引流

解析：该患者右大腿中段红肿，压痛明显，有波动感，为原发感染病灶。在此基础上患者出现寒战、高热、白细胞明显增高（白细胞正常值为4～10×10⁹/L），提示由局部感染灶引发全身性感染（包括菌血症、脓毒症等）。全身性感染的治疗，关键是处理原发感染灶。该患者原发感染灶右大腿处脓肿有波动感，表明脓肿已成熟，最恰当的处理是行脓肿切开引流（E对），否则大量细菌在体内繁殖，大量毒素被吸收，不利于控制感染蔓延。在病原菌未明确时，应选用广谱抗生素，不应选用针对G⁻菌的抗生素（A错）。输注新鲜血（B错）为一般支持治疗措施。糖皮质激素（C错）对免疫有抑制作用，不利于感染的控制，不宜普遍用于脓毒症，脓毒症休克时可以考虑。该患者血压100/75mmHg，未达到休克诊断标准（收缩压＜90mmHg，脉压＜20mmHg），不宜抗休克治疗（D错）。